患者，男，65岁。陈旧性心肌梗死病史，近日劳累后心悸，气短咳喘，乏力，动则加剧，神疲，舌淡有齿痕，脉细缓。治疗应首先考虑的方剂是
A. 葶苈大枣泻肺汤
B. 苓桂术甘汤
C. 补阳还五汤
D. 真武汤
E. 养心汤合补肺汤

正确答案：E。养心汤合补肺汤

解析：患者年龄较大，且有陈旧性心肌梗死病史，症状于活动后出现，诊断为心力衰竭心肺气虚证，治法当补益心肺，方药选择养心汤合补肺汤加减（E对）。葶苈大枣泻肺汤（A错）与真武汤（D错）合用适用于心肌梗死阳虚水泛证，患者未见水肿以及形寒肢冷等症状，非阳虚水泛，故不适用。苓桂术甘汤（B错）适用于心力衰竭痰饮阻肺证。补阳还五汤能益气活血、通脉止痛，适用于气虚血瘀导致的胸痹，症见胸痛的患者，本题中，患者以心悸乏力为主，未见胸痛（C错）。